用社会医学研究方法选择课题时要注意的原则中不包括
A. 需要性原则
B. 创造性原则
C. 特异性原则
D. 可行性原则

正确答案：C。特异性原则

解析：本题考查用社会医学研究方法选择课题时要注意的原则。用社会医学研究方法选择课题时涉及对课题的评价和可行性论证，课题的评价可根据需要性原则（A对）、创造性原则（B对）、科学性原则来评价一个课题是否值得研究；课题的可行性论证（D对）实际上就是判断一个课题是否有条件开展，可行性论证要从进行一项研究应该具备的主客观条件来判断。客观条件主要指科学发展的程度、各方面资料的积累，有关人力物力的配备、调查能否进行等；主观条件是指研究人员专业知识及各种相关技能等。特异性原则（C错，为本题正确答案）不是用社会医学研究方法选择课题时的原则。